正常成人禁食24小时后，体内葡萄糖来自体内蛋白质的糖异生，每日约耗损蛋白
A. 80g
B. 75g
C. 70g
D. 65g
E. 60g

正确答案：B。75g

解析：禁食24小时后，肝糖原即被耗尽，体内葡萄糖来自体内蛋白质的糖异生，每日约耗损蛋白75g（B对）。